女，48岁。因胆道梗阻，并发休克入院。使用去甲肾上腺素升压，血压不易维持，波动较大，应用氢化可的松后血压升并维持平稳。治疗3天时，患者出现精神失常，躁狂。患者出现精神失常，躁狂，因氢化可的松
A. 提高中枢神经的兴奋性
B. 加速蛋白质的分解代谢
C. 减少脑组织对葡萄糖的利用
D. 过量引起感染的扩散
E. 增强升压药的作用

正确答案：A。提高中枢神经的兴奋性

解析：氢化可的松可提高中枢的兴奋性（A对），是患者出现精神失常，躁狂等临床表现的原因。加速蛋白质的分解代谢（B错）、减少脑组织对葡萄糖的利用（C错）、过量引起感染的扩散（D错）、增强儿茶酚胺类血管收缩升压药的作用（E错）都属于糖皮质激素的药理作用，但不是患者出现精神失常，躁狂的原因。